男，72岁。排便时突然跌倒，呼之不应。诊断为心脏骤停。有陈旧心肌梗死和糖尿病病史。最佳的给药途径是
A. 口服
B. 动脉注射
C. 皮下注射
D. 静脉注射
E. 肌肉注射

正确答案：D。静脉注射

解析：目前心肺复苏的主要给药方法有静脉注射、气管内给药和心内注射。其中静脉注射是心肺复苏的主要途径，心脏骤停患者在进行心肺复苏时应尽早开通静脉通道，因静脉注射可使药物直接进入血液循环，产生药效快。故心脏骤停时最佳给药途径是静脉注射（D对）。口服药物（A错）吸收较慢且不规则，药效易受胃肠功能及胃肠内容物的影响。动脉注射（B错）常用于局部癌症的化学疗法（选择给癌症所在部位供血的相应动脉）、缺血性脑血管病变（选择颈动脉）、动脉硬化闭塞症及下肢深静脉血栓（选择股动脉）等。皮下注射（C错）主要在需迅速达到药效、不能或不宜经口服给药时采用，如胰岛素口服在胃肠道内易被消化酶破坏，失去作用，而皮下注射则迅速被吸收。肌肉注射（E错）主要用于不宜或不能做静脉注射，要求比皮下注射更迅速发生疗效时，以及注射刺激性较强或药量较大的药物时。